患者，女，58岁，血糖升高10年，口服二甲双胍治疗，高血压病史5年，未规律治疗，近期查体：血压158/95mmHg，尿常规示蛋白尿(+++），适宜该患者使用的降压药物是
A. 硝苯地平
B. 普萘洛尔
C. 甲基多巴
D. 依那普利
E. 特拉唑嗪

正确答案：D。依那普利

解析：本题考查降压药物。患者出现题干症状适宜使用的降压药物是依那普利（D对）。依那普利为血管紧张素转化酶抑制剂，ACEI能保护肾功能，可改善肾脏的血流动力学，进一步改善肾脏的盐分泌，减缓慢性肾病和肾脏损伤的发展，可同时改善糖尿病患者多蛋白尿或微量蛋白尿，延缓肾脏损害。硝苯地平（A错）为钙通道阻滞剂，用于心绞痛，如变异型心绞痛、不稳定型心绞痛、慢性稳定型心绞痛，高血压（单独或与其它降压药合用）。普萘洛尔（B错）为β-肾上腺受体阻滞剂，用于高血压、心率失常、减轻心绞痛、心悸与昏厥等症状等。甲基多巴（C错）为肾上腺素受体激动药，用于高血压。特拉唑嗪（E错）为泌尿系统药，用于良性前列腺增生症和高血压的治疗。